脊髓灰质炎的瘫痪特点是
A. 对称性迟缓性瘫痪，有感觉障碍
B. 对称性迟缓性瘫痪，无感觉障碍
C. 不对称性迟缓性瘫痪，有感觉障碍
D. 不对称性迟缓性瘫痪，无感觉障碍
E. 双下肢痉挛性瘫痪，无感觉障碍

正确答案：D。不对称性迟缓性瘫痪，无感觉障碍

解析：脊髓灰质炎的瘫痪特点是不对称性迟缓性瘫痪，无感觉障碍（D对）。